切面类白色至淡红棕色，粉性，可见点状维管束及多数小亮点的饮片是
A. 粉葛
B. 泽泻
C. 山药
D. 土茯苓
E. 天花粉

正确答案：D。土茯苓

解析：本题考查的是土茯苓饮片的性状鉴别。切面类白色至淡红棕色，粉性，可见点状维管束及多数小亮点的饮片是土茯苓（D对）。土茯苓：【性状鉴别】饮片呈长圆形或不规则薄片，边缘不整齐。切面黄白色或红棕色，粉性，可见点状维管束及多数小亮点；以水湿润后有黏滑感。气微，味微甘、涩。粉葛（A错）：【性状鉴别】饮片呈不规则的厚片或立方块状。外表面黄白色或淡棕色。切面黄白色，横切面有时可见由纤维形成的浅棕色同心性环纹，纵切面可见由纤维形成的数条纵纹。体重，质硬，富粉性。气微，味微甜。泽泻（B错）：【性状鉴别】饮片为圆形或椭圆形厚片。外表皮淡黄色至淡黄棕色，可见细小突起的须根痕。切面黄白色至淡黄色，粉性，有多数细孔。气微，味微苦。山药（C错）：【性状鉴别】饮片山药片为类圆形、椭圆形或不规则形的厚片，表面类白色或淡黄白色。质脆，易折断，切面类白色，富粉性。气微，味淡、微酸，嚼之发黏。天花粉（E错）：【性状鉴别】饮片为类圆形、半圆形或不规则形厚片。外表皮黄白色或淡棕黄色。切面可见黄色木质部小孔，略呈放射状排列。气微，味微苦。